患者，男，68岁。因感冒伴发口唇成群小水疱，破溃后呈糜烂与结痂，自觉瘙痒，灼热。其治法是
A. 内服黄连解毒汤
B. 内服普济消毒饮
C. 内服五味消毒饮
D. 外搽青吹口散油膏
E. 外搽白玉膏

正确答案：D。外搽青吹口散油膏

解析：热疮，是发热后或高热过程中在皮肤黏膜交界处所发生的急性疱疹性皮肤病，相当于西医的单纯疱疹，其特点是皮损为成群的水疱，有的相互融合，四周红晕，疱液清亮，破裂后露出糜烂面，逐渐干燥结痂脱落而愈，多在1周后痊愈，易于复发，自觉瘙痒及灼热感，本病例患者在感冒时伴发口唇部水疱、糜烂、结痂、瘙痒和灼热，皮疹特点与之相符，诊断为热疮，治疗以清热解毒养阴为主，内治：肺胃热盛者者，宜疏风清热，用辛夷清肺饮合竹叶石膏汤；湿热下注者，宜清热利湿，用龙胆泻肝汤加板蓝根、紫草、玄胡等；阴虚内热者，宜养阴清热解毒利湿，用增液汤加板蓝根、马齿苋、紫草、生苡仁 外治：可用紫金锭磨水外搽，或金黄散蜂蜜调敷，或青吹口散油膏、黄连膏外搽，每日2～3次（D对）。黄连解毒汤，具有泻火解毒的作用，用于疔疮及一切火毒热毒、发热、汗出、口渴等实证（A错）。普济消毒饮，具有散风温、清三焦、解毒热的作用，用于锁喉痈、发颐、抱头火丹等（B错）。五味消毒饮，具有清热解毒的作用，用于疔疮初起，壮热憎寒（C错）。白玉膏，具有润肤、生肌、收敛的作用，用于溃疡腐肉已尽，疮口不敛者（E错）。